动物性食物中兽药残留的来源不包括
A. 滥用药物
B. 使用违禁的药物
C. 使用淘汰的药物
D. 按规定在饲料中添加药物
E. 滥用饲料药物添加剂

正确答案：D。按规定在饲料中添加药物